可通过促进房水流出以及眼内反应脱敏感化，降低眼压的药物是
A. 去甲肾上腺素
B. 肾上腺素
C. 多巴胺
D. 异丙肾上腺素
E. 乙酰胆碱

正确答案：B。肾上腺素

解析：肾上腺素可可通过促进房水流出以及使β受体介导的眼内压反应脱敏感化，降低眼压。掌握“多巴胺和异丙肾上腺素”知识点。